关于用力呼吸的描述，不正确的是
A. 呼气时腹壁肌收缩
B. 吸气时膈肌收缩
C. 吸气时辅助吸气肌参与收缩
D. 呼气时肋间内肌收缩
E. 呼气时肋间外肌收缩

正确答案：E。呼气时肋间外肌收缩

解析：用力呼吸的主要的吸气肌为膈肌（B对）和肋间外肌（E错，为本题正确答案），主要的呼气肌为肋间内肌（D对）和腹肌（A对），当机体运动或吸入气中C02含量增加而02含量减少或肺通气阻力增大时，呼吸加深加快，此时不仅吸气肌舒缩活动加强，辅助吸气肌（C对）与呼气肌也参与呼吸运动。